某化学物质经动物实验致癌证据充分，但流行病学调查资料尚不足，它应归类于
A. 确认致癌物
B. 潜在致癌物
C. 可疑致癌物
D. 动物致癌物
E. 人类致癌物

正确答案：B。潜在致癌物